全口义齿制作中使用（牙合）托的最主要目的是
A. 便于排牙
B. 恢复垂直距离
C. 颌位记录
D. 恢复面部外形
E. 确定（牙合）平面

正确答案：C。颌位记录

解析：本题考查（牙合）托的最主要目的。（牙合）托由基托和（牙合）堤组成，用于上、下颌的垂直与水平关系的记录与转移，即颌位记录（C对），这也是（牙合）托最主要的作用和目的。但除此之外，（牙合）堤还可用于指导人工前牙和后牙的选择与排列，便于排牙（A错），（牙合）托有助于恢复垂直距离（B错）、有助于恢复面部外形（D错）和确定（牙合）平面（E错），只是这些都不是（牙合）托的最主要的目的。